了解溃疡病患者胃酸分泌情况应选用
A. 胃镜检查
B. 钡餐造影
C. 腹部CT
D. 腹部B超
E. 胃液分析

正确答案：E。胃液分析

解析：胃液分析（E对）可测定基础胃酸分泌量（BAO）和最大胃酸分泌量（MAO），用于了解溃疡病患者胃酸分泌情况，区分胃溃疡与十二指肠溃疡：胃溃疡患者BAO和MAO均正常或偏低，十二指肠溃疡患者BAO和MAO均升高。胃镜检查（A错）和钡餐造影（B错）一般用于消化性溃疡和胃癌的诊断；腹部CT（C错）及腹部B超（D错）用于检测腹腔内的实质性脏器。